利用X射线的穿透等性质取得人体内器官与组织的影像信息以诊断疾病的技术的是
A. 放射治疗
B. 核医学
C. 介入放射学
D. X射线影像诊断
E. B超

正确答案：D。X射线影像诊断

解析：利用X射线的穿透等性质取得人体内器官与组织的影像信息以诊断疾病的技术的是X射线影像诊断。掌握“放射诊疗的概念分类及执业条件”知识点。